女，33岁，G1P0，妊娠26+3周，BMI28，空腹血糖5.0，有家族糖尿病史，下一步如何处理
A. 行OGTT试验
B. 复查空腹血糖
C. 排除糖尿病诊断，定期产检
D. 查尿糖
E. 查尿酮

正确答案：A。行OGTT试验

解析：患者女，33岁，G1P0，妊娠26+3周，BMI28，空腹血糖5.0，有家族糖尿病史（妊娠期糖尿病的高危因素），结合患者病史和空腹血糖的检查结果，下一步应行OGTT试验明确是否是妊娠期糖尿病（A对）。